胰岛素对脂肪代谢调节错误的是
A. 促进脂肪合成和贮存
B. 加速葡萄糖合成脂肪酸
C. 抑制对激素敏感的脂解酶的活性
D. 抑制葡萄糖进入脂肪细胞
E. 胰岛素缺乏，可造成脂类代谢的严重紊乱、血脂升高、引起动脉硬化

正确答案：D。抑制葡萄糖进入脂肪细胞